任何窝洞都需要
A. 合适的外形，固位形和抗力形
B. 合适的外形和抗力形
C. 合适的外形和固位形
D. 合适的固位形和抗力形

正确答案：A。合适的外形，固位形和抗力形

解析：本题考查窝洞的结构。窝洞预备时，应根据龋损范围预备出合适的窝洞外形，以便于充填修复材料恢复龋损牙齿的形态和功能，因此窝洞需要预备出洞壁、洞角、洞缘等基本结构；窝洞需要有良好的固位形防止充填体移位和脱落；窝洞还需要良好的抗力形防止充填体和牙体组织承受咬合力时折裂，因此任何窝洞都需要同时具备合适的外形，固位形和抗力形（A对BCD错）。